乳牙氟斑牙少见的原因如下
A. 所有乳牙发育矿化在胚胎期完成
B. 母体含氟量低
C. 乳牙抗氟能力强
D. 母乳中不含氟
E. 胎盘对氟有一定的屏障作用

正确答案：E。胎盘对氟有一定的屏障作用

解析：本题考查氟牙症。乳牙氟斑牙少见的原因如下胎盘对氟有一定的屏障作用（E对）。胎盘对氟有一定的限制作用，可以减少氟的吸收。氟牙症又称氟斑牙或斑釉，多见于恒牙，发生在乳牙者甚少，程度亦较轻。这是由于乳牙的发育分别在胚胎期和婴儿期（A错），而胎盘对氟有一定的屏障作用。但如氟摄入量过多，超过胎盘筛除功能的限度时，也能不规则地表现在乳牙上。